男，19岁。咽痛、发热伴咳嗽2周，眼睑水肿伴肉眼血尿3天。查体：BP150/100mmHg，全身皮肤无皮疹。实验室检查：尿蛋白（++），尿红细胞30～40/HP，管型3～5/LP，补体C₃降低，SCr126μmol/L。该患者治疗不包括
A. 糖皮质激素
B. 利尿
C. 控制血压
D. 休息
E. 抗生素

正确答案：A。糖皮质激素

解析：急性肾小球肾炎为自限性疾病，以休息（D对）及对症治疗为主，如利尿（B错），控制血压（C对），抗生素（E对）抗感染等对症支持治疗，不宜使用糖皮质激素（A错，为本题正确答案）及细胞毒药物治疗。